牲畜屠宰时肉的pH范围是
A. 4.4～5.4
B. 5.5～6.7
C. 7.0～7.4
D. 7.5～8.4
E. 8.5～8.9

正确答案：C。7.0～7.4

解析：本题考查牲畜屠宰时肉的pH范围。牲畜屠宰时肉呈中性或弱碱性，pH范围是pH 7.0～7.4（C对ABDE错）。